下列属于应对心理应激的方法是
A. 学会放松和自我调节
B. 请心理咨询或心理治疗师给予帮助
C. 提高自身应对能力与经
D. 采用自我防御机制
E. 以上说法均正确

正确答案：E。以上说法均正确

解析：应对心理应激的方法：消除、逃避或回避应激源；调整对应激事件的认知和态度，常常需要降低期望值；增加对应激事件的可控性和可预测性；提高自身应对能力与经验；采用自我防御机制；学会放松和自我调节；取得社会支持和安慰，利用各种有效的外在资源；请心理咨询或心理治疗师给予帮助，必要时选用适当药物。掌握“心理应激”知识点。